具有酯类结构的抗心绞痛药是
A. 盐酸地尔硫䓬
B. 硝苯吡啶
C. 盐酸普萘洛尔
D. 硝酸异山梨酯
E. 盐酸哌唑嗪

正确答案：D。硝酸异山梨酯

解析：本题考查硝酸异山梨酯。硝酸异山梨酯（D对）是具有酯类结构的抗心绞痛药，能够扩张血管，用于急性心绞痛发作。盐酸地尔硫䓬（A错）结构含硫氮杂䓬。硝苯吡啶（B错）结构含二氢吡啶，为钙离子拮抗剂。盐酸普萘洛尔（C错）结构含氨基醇，为非选择性β-受体阻断药。盐酸哌唑嗪（E错）结构含苯并嘧啶，为选择性α受体阻滞剂。